三子养亲汤主治
A. 痰壅气逆食滞证
B. 热痰咳嗽证
C. 燥痰咳嗽证
D. 风痰上扰证
E. 湿热食滞证

正确答案：A。痰壅气逆食滞证

解析：三子养亲汤中白芥子温肺化痰，利气畅膈；苏子降气消痰，止咳平喘；莱菔子消食导滞，降气祛痰。共奏降气，化痰，消食之功，主治痰壅气逆食滞证（A对）。